血清型IgA主要存在于血清中，为
A. 多体
B. 自体
C. 单体
D. 二聚体
E. 免疫体

正确答案：C。单体

解析：血清型IgA为单体，主要存在于血清中。掌握“各类球蛋白的特性和功能”知识点。